牙周脓肿病因不包括
A. 脓性渗出物不能顺利引流
B. 机体抵抗力较强，年轻患者多发
C. 牙髓治疗时根管及髓室底侧穿、牙根纵裂
D. 深牙周袋内壁的化脓性炎症向深部结缔组织扩展
E. 洁治或刮治时，动作粗暴，将牙石碎片推入牙周袋深部组织

正确答案：B。机体抵抗力较强，年轻患者多发

解析：牙周脓肿病因：①深牙周袋内壁的化脓性炎症向深部结缔组织扩展，而脓液不能向袋内排出时，即形成袋壁软组织内的脓肿。②迂回曲折的、涉及多个牙面的复杂型深牙周袋，脓性渗出物不能顺利引流，特别是累及根分叉区时。③洁治或刮治时，动作粗暴，将牙石碎片推入牙周袋深部组织，或损伤牙龈组织。④深牙周袋的刮治术不彻底，袋口虽然紧缩，但袋底处的炎症仍然存在，且得不到引流。⑤有牙周炎的患牙（或无牙周袋的牙齿）遭受创伤，或牙髓治疗时根管及髓室底侧穿、牙根纵裂等，有时也可引起牙周脓肿。⑥机体抵抗力下降或有严重全身疾患，如糖尿病等，易发生牙周脓肿。掌握“牙周脓肿”知识点。